能溶于水的生物碱是
A. 莨菪碱
B. 小檗碱
C. 长春新碱
D. 长春碱
E. 长春地辛

正确答案：B。小檗碱

解析：本题考查的是亲水性生物碱。能溶于水的生物碱是小檗碱（B对）。小檗碱属于季胺型生物碱。亲水性生物碱：①季铵型生物碱：这类生物碱为离子型化合物，易溶于水和酸水，可溶于甲醇、乙醇及正丁醇等极性较大的有机溶剂，难溶于亲脂性有机溶剂。②含N-氧化物结构的生物碱：这类生物碱具配位键结构，可溶于水，如氧化苦参碱。③小分子生物碱：少数分子较小而碱性较强的生物碱，既可溶于水，也可溶于三氯甲烷，如麻黄碱、烟碱等。④酰胺类生物碱：由于酰胺在水中可形成氢键，所以在水中有一定的溶解度，如秋水仙碱、咖啡碱。